可用于1岁以下婴幼儿急、慢性腹泻，具有固定和清除多种病原体和毒素药物是
A. 地芬诺酯
B. 洛哌丁胺
C. 番泻叶
D. 蒙脱石散
E. 酚酞

正确答案：D。蒙脱石散

解析：本题考查泻药与止泻药类药物。蒙脱石散（D对）可用于1岁以下婴幼儿急、慢性腹泻，具有固定和清除多种病原体和毒素药物；番泻叶（C错）、酚酞（E错）为刺激性泻药，用于治疗便秘；地芬诺酯（A错）、洛哌丁胺（B错）属于抗动力药，适用于成年人无合并症的急性腹泻，而不适于幼儿，禁用于2岁以下儿童。